进餐时服用，可减少脂肪吸收的药品是
A. 苯扎贝特
B. 吉非贝齐
C. 阿昔莫司
D. 奥利司他
E. 非诺贝特

正确答案：D。奥利司他